DentobuffStrip试验的目的
A. 了解唾液的缓冲能力
B. 主要观察乳杆菌在唾液的数量
C. 检测牙表面菌斑内产酸菌的产酸能力
D. 用颜色显色法观察唾液内变形链球菌的数量
E. 观察唾液中每毫升菌落形成单位（CFU/ml）的变形链球菌数量来判断龋的活性

正确答案：A。了解唾液的缓冲能力

解析：DentobuffStrip试验目的：了解唾液的缓冲能力。掌握“龋病预测与早期诊断”知识点。